多囊卵巢综合征的常见月经改变是
A. 月经周期正常，经量过多
B. 月经频发
C. 月经周期正常，经量过少
D. 月经周期正常，经期延长
E. 月经稀发

正确答案：E。月经稀发

解析：多囊卵巢综合征的常见月经改变为月经稀发（周期35日至6个月）（E对）或闭经。月经周期正常、经量过多（P349）（A错）为月经过多常见表现。月经频发（P350）（B错）为黄体功能不足常见表现。月经周期正常、经量过少（C错）为卵巢功能衰竭的常见表现。月经周期正常、经量延长（P351）（D错）为子宫内膜不规则脱落的常见表现。